地方性克汀病可表现为
A. 智力低下
B. 骨质硬化与骨质疏松
C. 多发性病理骨折
D. 视野缩小
E. 皮肤色素沉着

正确答案：A。智力低下

解析：本题考查地方性克汀病的临床表现。地方性克汀病原系指欧洲阿尔卑斯山区常见的一种体格发育落后、痴呆和聋哑的疾病。这是在碘缺乏地区出现的一种比较严重碘缺乏病的表现形式。可表现为：智力低下（A对BCDE错）、聋哑、生长发育落后、神经系统症状、甲状腺功能低下症状、甲状腺肿。